在检查龋洞时，光导纤维对下列哪组牙齿效果最好
A. 上、下前牙邻面
B. 上磨牙邻面
C. 下磨牙邻面
D. 上、下双尖牙邻面
E. 以上均包括

正确答案：A。上、下前牙邻面

解析：本题考查透照法检查。检查邻面龋时，光导纤维检查上、下前牙邻面效果明显（A对），龋坏处不透光，健康牙体组织则可透光，可直接看出龋损部位和病变深度、范围。上磨牙邻面（B错）、下磨牙邻面（C错）和上、下双尖牙邻面（D错）牙体较厚，透光性不好。